淋巴结检查的正确顺序应是
A. 枕部、耳后、耳前、腮腺、颊、颌下、颏下
B. 腮腺、颊、颌下、颏下、枕部、耳后、耳前
C. 颌下、颏下、枕部、耳后、耳前、腮腺、颊
D. 耳后、耳前、腮腺、颊、颌下、颏下、枕部
E. 颊、颌下、颏下、枕部、耳后、耳前、腮腺

正确答案：A。枕部、耳后、耳前、腮腺、颊、颌下、颏下

解析：检查者手指紧贴检查部位，按一定顺序，由浅入深，滑动触诊。一般的顺序为：枕部、耳后、耳前、腮腺、颊、颌下、颏下；顺胸锁乳突肌前后缘、颈前后三角、直至锁骨上凹，仔细检查颈深、浅淋巴结，颈部淋巴结的所在部位和引流方向。掌握“口外一般检查及辅助检查”知识点。